按照污染物进入土壤的途径，不属于土壤污染源分类的是
A. 农业污染源
B. 工业污染源
C. 生活、交通污染源
D. 灾害污染源
E. 生物污染源

正确答案：E。生物污染源

解析：本题考查土壤污染源的分类。土壤污染是指在人类生产和生活活动中排出的有害物质进入土壤中，超过一定限量，直接或间接地危害人畜健康的现象。按照污染物进入土壤的途径，可将土壤污染源分为以下几类：1.工业污染源（B对）：是指工矿企业排放的废水、废气和废渣等；2.农业污染源（A对）：主要是指基于农业生产自身需要而施入土壤的化肥、农药以及其他农用化学品（如残留于土壤中的农用地膜）等；3.生活污染源：主要指人粪尿及畜禽排泄物以及城市生活垃圾的不合理处置；4.交通污染源（C对）：主要体现在汽车尾气中的各种有毒有害物质通过大气沉降造成对土壤的污染，以及事故排放所造成的污染；5.灾害污染源（D对）：某些自然灾害和战争灾害有时也会造成土壤污染；6.电子垃圾污染：电子垃圾含有 Pb、Cd、Hg、六价铬、聚氯乙烯塑料、溴化阻燃剂等大量有毒有害物质。生物污染源（E错，为本题正确答案）不属于土壤污染源的分类。